苯巴比妥含量测定所使用的滴定液是
A. 高氯酸滴定液
B. 亚硝酸钠滴定液
C. 氢氧化钠滴定液
D. 盐酸滴定液
E. 硝酸银滴定液

正确答案：E。硝酸银滴定液

解析：本题考查常用的药品鉴别方法。苯巴比妥含量测定所使用的滴定液是硝酸银滴定液（E对）。《中国药典》采用银量法测定苯巴比妥的含量，以电位法指示终点。方法：取供试品约0.2g，加甲醇40ml使溶解，再加新制的3%无水碳酸钠溶液15ml，用硝酸银滴定液（0.1mol/L）滴定。非水碱量法是以冰醋酸或冰醋酸-醋酐为溶剂，用高氯酸的冰醋酸溶液为滴定液（A错）滴定，以结晶紫或电位法指示滴定终点的一类方法。亚硝酸钠滴定法是以亚硝酸钠为标准溶液，利用亚硝酸钠与有机胺类物质发生重氮化反应或亚硝基化反应进行的氧化还原滴定法（B错）。氢氧化钠滴定（C错）和盐酸滴定（D错）均属于酸碱滴定法，适用于一般的酸、碱以及能与酸、碱直接或间接发生质子转移的物质。